用于评估伏马菌素接触水平的有效接触/效应性生物学标志物是
A. 血液肝功能酶活性
B. 血液胆碱酯酶活性
C. 尿液伏马菌素-2，3环氧化物
D. 血液伏马菌素-2，3环氧化物
E. 尿液中二氢神经鞘氨醇/神经鞘氨醇比值

正确答案：E。尿液中二氢神经鞘氨醇/神经鞘氨醇比值

解析：本题考查用于评估伏马菌素接触水平的有效接触/效应性生物学标志物。伏马菌素则可通过计算尿液中二氢神经鞘氨醇/神经鞘氨醇比值（E对ABCD错）作为评估接触水平的有效接触/效应性生物学标志物。